女性，45岁。全口牙出血、咀嚼无力。2年前诊断为1型糖尿病。口腔检查：全口多数牙牙周袋深达5mm，松动Ⅰ°～Ⅱ°，牙石（++），牙龈探诊出血，初步诊断为与糖尿病有关的牙周炎，何时进行牙周治疗效果最好
A. 糖尿病控制前
B. 控制糖尿病与牙周治疗同时进行
C. 糖尿病控制后
D. 糖尿病控制后又失控时
E. 以上时机均可

正确答案：C。糖尿病控制后

解析：本题考查与糖尿病有关的牙周炎的治疗。女性，45岁。全口牙出血、咀嚼无力。2年前诊断为1型糖尿病。口腔检查：全口多数牙牙周袋深达5mm，松动Ⅰ°～Ⅱ°，牙石（++），牙龈探诊出血，初步诊断为与糖尿病有关的牙周炎，糖尿病控制后（C对）进行牙周治疗效果最好。①血糖控制理想的患者，牙周治疗操作同全身健康者；②血糖控制良好的患者，牙周治疗操作同全身健康者，尽量采取非手术治疗；③血糖控制差甚至存在并发症或者大剂量使用胰岛素的患者可进行非手术治疗，预防性使用抗生素减少治疗后感染和伤口不愈的发生；④血糖控制极差，牙科治疗后感染率增大，建议仅做对症应急处理（脓肿切开引流、全身辅助抗生素应用、口腔卫生指导、局部用药），待血糖控制再开始行牙周常规治疗。